毒性较大的微囊藻毒素MC-LR、MC-RR和MC-YR，其中L、R、Y分别代表
A. 亮氨酸、精氨酸和苏氨酸
B. 蛋氨酸、精氨酸和苏氨酸
C. 谷氨酸、精氨酸和苏氨酸
D. 亮氨酸、精氨酸和酪氨酸
E. 蛋氨酸、精氨酸和苏氨酸

正确答案：D。亮氨酸、精氨酸和酪氨酸

解析：本题考查微囊藻毒素。微囊藻毒素有70多种异构体，毒性较大的是MC-LR，MC-RR和MC-YR，其中L、R、Y分别代表亮氨酸、精氨酸和酪氨酸（D对ABCE错）。